检查9个人的血型，其中A型2人，B型3人，O型3人，AB型1人。其对应的变量类型是
A. 数值变量
B. 4项无序分类资料
C. 4项有序分类资料
D. 9项无序分类资料
E. 9项有序分类资料

正确答案：B。4项无序分类资料

解析：本题考查数据类型的相关内容。无序分类变量（ACE错）的各个取值间则没有程度的差异，比如性别、血型。对于无序分类变量，根据取值的不同又可分为二项分类变量和多项分类变量，比如性别取值为相互对立的两类，而血型取值则为互不相容的多个类别且为4项（B对D错）。